分子中含有苯并咪唑基团和羧基，不含四氮唑基的药物是
A. 替米沙坦
B. 氯沙坦
C. 依普罗沙坦
D. 厄贝沙坦
E. 缬沙坦

正确答案：A。替米沙坦

解析：本题考查AⅡ受体阻断药。替米沙坦（A对）是分子中不含四氮唑的AⅡ受体阻断药，分子中的酸性基团为羧基。